肾性贫血发生的主要原因是
A. 促红细胞生成素减少
B. 出血
C. 红细胞生存期缩短
D. 骨髓造血功能受抑制
E. 以上都相关

正确答案：E。以上都相关

解析：肾性贫血的发生机制：①促红细胞生成素生成减少（A对）；②骨髓造血功能的抑制（D对）；③出血（B对）；④毒性物质使红细胞破坏增加，红细胞生存期缩短（C对）；⑤肾毒物可引起肠道对铁和叶酸等造血原料的吸收减少或利用障碍等。综上，以上都正确（E对）。